分解痰液黏蛋白成分而发挥祛痰作用的药物是
A. 氯化铵
B. 右美沙芬
C. 乙酰半胱氨酸
D. 愈创木酚甘油醚
E. 碘化钾

正确答案：C。乙酰半胱氨酸

解析：本题考查乙酰半胱氨酸。分解痰液黏蛋白成分而发挥祛痰作用的药物是乙酰半胱氨酸（C对）。乙酰半胱氨酸结构中的巯基（-SH）能与黏蛋白二硫键（-S-S-）结合，使黏蛋白分子裂解，降低痰的黏性，易于咳出。氯化铵（A错）和愈创木酚甘油醚（D错）是恶心性祛痰药，通过刺激胃黏膜，引起轻微的恶心，反射性引起支气管黏膜腺体分泌增加，降低痰液黏性，痰液得到稀释而易于咳出，适用于呼吸道感染引起的咳嗽、多痰。右美沙芬（B错）为中枢性镇咳药。碘化钾（E错）临床上主要用于预防和治疗地方性甲状腺肿，以及用于甲状腺功能亢进症手术前准备，用于治疗甲状腺亢进危象。